最有助于诊断室性心动过速的心电图特点是
A. T波和主波方向相反
B. 心室夺获
C. QRS波群宽大畸形
D. QRS波群呈束支传导阻滞图形
E. PR间期延长

正确答案：B。心室夺获

解析：最有助于诊断室性心动过速的心电图特点是心室夺获（B对）和室性融合波。心室夺获表现为在P波之后，提前发生一次正常的QRS波，室性融合波的QRS波形态介于窦性与异位心室搏动之间，意义为部分夺获心室。出现下列心电图表现提示为室速：①室性融合波；②心室夺获；③室房分离；④全部心前区导联QRS波主波方向呈同向性，即全部向上或向下。QRS波群宽大畸形（C错）（P198）也属于室性心动过速的心电图特点。T波和主波方向相反（A错）是室性期前收缩的心电图特征（P196）。QRS波群呈束支传导阻滞图形（D错）可见于一度、二度房室传导阻滞（P202-P203）。PR间期延长（E错）多见于房室传导阻滞，最常见的是一度房室传导阻滞，也可见于其他问题。